下列关于动脉的叙述哪项不正确
A. 动脉是导血离开心脏的管道
B. 其内流动的均为动脉血
C. 动脉管腔内一般无瓣膜
D. 一般终于毛细血管
E. 动脉间可以吻合成动脉弓或动脉网

正确答案：B。其内流动的均为动脉血

解析：动脉是导血离开心脏的管道（A对）。肺动脉干及其分支内流动的为静脉血（B错，为本题正确答案）。动脉管腔内一般无瓣膜（C对）。动脉最后移行为毛细血管（D对）。动脉间可以吻合成动脉弓或动脉网（E对）。